肠溶性固体分散物载体材料
A. PVP
B. EC
C. HPMCP
D. MCC
E. EudragitRL，RS

正确答案：C。HPMCP